旋覆花、代赭石在旋覆代赭汤中的配伍意义是
A. 温胃化痰止呕
B. 平冲降逆止呕
C. 祛痰降逆和胃
D. 镇冲逆除噫气
E. 化痰消食和胃

正确答案：D。镇冲逆除噫气

解析：本题考查旋覆代赭汤的方解。旋复代赭汤证由胃虚痰阻，气逆不降所致。胃主受纳，腐熟水谷，其气以下行为顺。胃气虚则升降失常，胃气因虚而上逆，则噫气频作，反胃呕吐，或吐涎沫；胃虚运化失职，湿聚生痰，痰阻气机，则心下痞；舌苔白滑，脉弦而虚，为中虚痰阻之征。胃虚宜补，痰浊宜化，气逆宜降。虽实虚并见，但以气逆痰阻为主，治宜降逆化痰，兼以益气和中。方中旋覆花功专下气消痰，降气止噫，为治痰阻气逆之要药，重用为君药。代赭石质重而沉降，善镇肝胃之冲逆，坠痰涎、止呕吐，为臣药。半夏、生姜祛痰散结，降逆和胃；人参、炙甘草、大枣健脾益胃，以复中虚，共为佐药。甘草又能调和诸药，兼使药之用。诸药合用，集祛痰、降逆、补虚于一方，使痰除、气降、脾健，诸证自愈（D对）。其它选项均不是旋覆代赭汤中药物的组成意义（ABCE错）。